Ante主张
A. 以（牙合）力比值决定基牙数目
B. 以缺牙数决定基牙数目
C. 以牙周膜面积决定基牙数目
D. 以缺牙部位决定基牙数目
E. 以上都不对

正确答案：C。以牙周膜面积决定基牙数目

解析：本题考查固定桥的生理基础。Ante曾提出基牙牙周膜面积的总和应等于或大于缺失牙牙周膜面积的总和。即基牙的数量应根据基牙与缺失牙牙周膜面积大小来衡量（C对）。假如缺失牙的牙周膜面积大于基牙牙周膜面积的总和，将给基牙带来创伤，最终导致固定桥修复的失败。